在中线的皮肤和颈浅筋膜的深面，可结合形成的颈白线的是
A. 颈深筋膜浅、中两层
B. 颈深筋膜浅、深两层
C. 颈深筋膜中、深两层
D. 颈浅筋膜、颈深筋膜浅层
E. 颈浅筋膜、颈深筋膜中层

正确答案：A。颈深筋膜浅、中两层

解析：在中线的皮肤和颈浅筋膜的深面，有由颈深筋膜浅、中两层结合形成的颈白线。掌握“气管颈段、颈动脉三角的解剖特点及临床应用”知识点。